女，26岁。足月分娩后12个月后出现持续的阴道不规则流血，血β-hCG持续高水平。CT示肺部转移灶。最有可能的诊断是
A. 胎盘部位反应
B. 胎盘残留
C. 绒毛膜癌
D. 葡萄胎
E. 侵袭性葡萄胎

正确答案：C。绒毛膜癌

解析：患者为年轻女性，足月分娩后12个月后出现持续的阴道不规则流血（滋养细胞肿瘤患者在葡萄胎排空、流产或足月产后，有持续的不规则阴道流血，量多少不定），血β-hCG持续高水平（足月分娩后hCG多在4周左右转为阴性，若超过4周血清hCG仍持续高水平，在除外妊娠物残留或再次妊娠后，可诊断妊娠滋养细胞肿瘤），考虑为滋养细胞肿瘤，其包括侵蚀性葡萄胎和绒毛膜癌。因患者为非葡萄胎妊娠，只继发绒癌，故最可能的诊断是绒毛膜癌（C对）；侵蚀性葡萄胎（E错）只继发于葡萄胎妊娠。葡萄胎（D错）为良性病变，常见临床表现为停经后阴道流血，子宫异常增大，血清hCG检查明显增高，但不会发生肺部转移。胎盘部位反应（A错）是与妊娠有关的中间型滋养细胞非肿瘤性高度增生的良性病变，临床表现为无诱因、持续性及顽固性的不规则阴道流血或严重产后出血，血清hCG检查多数阴性或轻度增高。胎盘残留（P212）（B错）指部分胎盘小叶、副胎盘或部分胎膜残留于宫腔，因影响子宫收缩而出血，出血量较多。